患者，女，16岁，症见身热恶寒，热轻寒重，无汗头痛，四肢不温，倦怠嗜卧，面色苍白，舌淡苔白，脉浮无力。治宜选用
A. 玉屏风散
B. 再造散
C. 葱白七味饮
D. 加味香苏散
E. 人参败毒散

正确答案：B。再造散

解析：题中患者以身热恶寒为主，诊断为感冒。阳虚外感风寒之邪，则热轻寒重，四肢不温；气虚，气对血失于温煦、推动，则倦怠嗜卧，面色苍白；风寒束表，卫阳被遏，络脉失和，则无汗头痛；气血虚弱，又感风寒，则舌淡苔白，脉浮无力，故诊断为阳虚外感，治疗应该用再造散助阳解表（B对）。玉屏风散益气固表止汗，主治表虚自汗，易感风邪者（A错）。葱白七味饮养血解表，主治血虚外感风寒证（C错）。加味香苏散发汗解表，理气解郁，主治外感风寒兼有气滞证（D错）。人参败毒散益气解表，散风祛湿，主治伤寒时气，头痛项强等（E错）。